患者，女，46岁。患高血压病10年。近1月来发现项下不适，可触摸到肿块，经诊断证属痰火郁结之瘿瘤。治疗应首选
A. 蒲公英
B. 龙胆草
C. 夏枯草
D. 连翘
E. 瓜蒌

正确答案：C。夏枯草

解析：夏枯草辛以散结，苦以泄热，有良好的清肝火，散郁结的作用，可治疗瘿瘤；现代研究夏枯草还具有降低血压的作用，患者患高血压病10年，现病瘿瘤，首选夏枯草治疗（C对）。蒲公英（A错）的功效是清热解毒，消肿散结，利尿通淋。龙胆草（B错）的功效：清热燥湿，泻肝胆火。连翘（D错）的功效是清热解毒，散结消肿，疏散风热。瓜蒌（E错）的功效是清热涤痰，宽胸散结，润燥滑肠。